理想的牙刷刷毛不应该具有
A. 易吸收水分
B. 适当弹性
C. 容易洗涤
D. 适当硬度
E. 表面光滑

正确答案：A。易吸收水分

解析：理想的刷毛应具有适当弹性、硬度，表面光滑、不易吸收水分，容易洗涤及干燥，无臭无味。掌握“自我口腔保健方法”知识点。